在体外没有抗癌作用的抗癌药物是
A. 阿糖胞苷
B. 多柔比星
C. 环磷酰胺
D. 卡莫司汀
E. 长春碱

正确答案：C。环磷酰胺